假定某一筛选计划检查了1000人，又假定某病的流行率为4%，而这种筛选试验的灵敏度为90%，特异度为80%。根据这些资料判断，被筛选出来的阳性者中真病人数是
A. 40人
B. 4人
C. 36人
D. 192人
E. 768人

正确答案：C。36人

解析：本题考查真阳性率（灵敏度）。真阳性率即实际患病且被筛检试验标准判断为阳性的百分比，它反映了筛检试验发现病人的能力。某病的流行率为4%，则患该病的人为1000×4%＝40人。已知特异度为80%，由特异度＝1－假阳性率，得出假阳性率为20%。已知灵敏度为90%，根据式（7-8）得真阳性率为90%，被筛选出来的阳性者中真病人数是：患病者×真阳性率＝40×90%＝36人（C对ABDE错）。